慢性铁缺乏发展的正确顺序为
A. 骨髓铁储存被动员和耗竭，血清铁降低，低血红蛋白，贫血
B. 血清铁降低，骨髓铁储存被动员和耗竭，贫血，低血红蛋白
C. 血清铁降低，贫血，骨髓铁储存被动员和耗竭，低血红蛋白
D. 骨髓铁储存被动员和耗竭，贫血，低血红蛋白，血清铁降低
E. 铁降低，低血红蛋白，贫血，骨髓铁储存被动员和耗竭

正确答案：A。骨髓铁储存被动员和耗竭，血清铁降低，低血红蛋白，贫血